对某化学毒物进行毒性试验，测定结果为：LD₅₀：896mg/kg，LD₀=152mg/kg，LD₁₀₀=1664mg/kg，Limac：64mg/kg，Limch：8mg/kg，其慢性毒作用带的数值为
A. 8
B. 14
C. 26
D. 112
E. 208

正确答案：A。8